育龄期崩漏，多属
A. 气血虚弱
B. 肾虚肝郁
C. 脾肾亏损
D. 肝郁血热
E. 肝郁脾虚

正确答案：B。肾虚肝郁

解析：崩漏的主要病因为虚（脾、肾）、热、瘀，三者可单独或复合成病，又互为因果，其病机为冲任损伤，不能制约经血。崩漏病本在肾，病位在冲任、胞宫。育龄期女子脏腑机能旺盛，肝肾与月经、生育密切，冲任之本在肾，肾病为虚证，且崩漏其本在肾，为肾虚，育龄期女子肝脏机能旺盛，易于出现肝郁气滞的病证，故育龄期崩漏多属肾虚肝郁（B对）。